肠燥津亏证的临床表现
A. 腹痛腹胀，暴泻如水，肛门灼热
B. 大便溏薄，时干时稀，排便不爽
C. 下痢脓血，里急后重，身热口渴
D. 腹满硬痛，大便秘结，日晡潮热
E. 大便燥结，艰涩难下，口干口臭

正确答案：E。大便燥结，艰涩难下，口干口臭

解析：各种原因损伤阴津，肠道失濡，传导不行，则大便干燥秘结，坚硬如羊屎，难以排出；腑气不通，秽浊不能下排而上逆，则口中出气秽臭（E对）。腹痛腹胀，暴泻如水，肛门灼热为肠道湿热证的临床表现（A错）。大便溏薄，时干时稀，排便不爽为肝郁脾虚证的临床表现（B错）。下痢脓血，里急后重，身热口渴为肠道湿热证的临床表现（C错）。腹满硬痛，大便秘结，日晡潮热为肠热腑实证的临床表现（D错）。